医患沟通的意义中不包括
A. 是医学目的的需要
B. 是提高医生技术水平的需要
C. 是临床治疗的需要
D. 是医学人文精神的需要
E. 是医学诊断的需要

正确答案：B。是提高医生技术水平的需要

解析：医患沟通的意义中不包括是提高医生技术水平的需要。1.医患沟通是医疗诊断的需要，疾病诊断的前提是对患者疾病起因、发展过程的了解，病史采集和体格检查就是与患者沟通和交流的过程，这一过程的质量，决定了病史采集的可靠程度和体格检查的可信度，在一定意义上也就决定了疾病诊断正确与否。医患沟通是临床治疗的需要，医疗活动必须由医患双方共同参与完成。2医患沟通是医学发展的需要，随着现代医学科技高速发展，临床医生对仪器的依赖性越来越大。社会-心理-生理医学模式的建立和发展，是医学人文精神的回归，医学的新模式使医患沟通比以往任何时候更显得重要。3.医患沟通是减少纠纷的需要，相当一部分医患纠纷，由于医患相互交流不足和沟通不够，致使患者对医疗服务内容和方式的理解与医护人员不一致，进而信任感下降所导致。4.医患沟通是双向性的需要，真正体现医学的整体意义和完整价值，实现医学事实与医学价值、医学知识和人性目的和谐统一，医患沟通方式可以以交谈为主，也可通过电话、书信等方法（B错，为本题正确答案）。